食管的第二个狭窄位于
A. 起始处
B. 穿膈处
C. 与左主支气管交叉处
D. 与右主支气管交叉处
E. 与胃相接处

正确答案：C。与左主支气管交叉处

解析：起始处(A错)为第1狭窄，穿膈处(B错)为第3狭窄，第二个狭窄位于与左主支气管的交叉处(C对DE错)。